患儿，男，5岁，体重25kg，有癫痫病史，青霉素过敏史。因急性胆囊炎合并腹腔感染住院治疗，体征和实验室检查：白细胞计数15.8×10³/L，体温39.5℃，肝、肾功能正常，医师处方美罗培南静脉滴注（说明书规定儿童剂量为一次20mg/kg）。患儿应用美罗培南的合理用法是
A. 0.5g，qd
B. 0.5g，q12d
C. 0.5g，q8d
D. 0.5g，q4d
E. 0.5g，q0d

正确答案：D。0.5g，q4d

解析：本题考查美罗培南的使用。根据题干中的该儿童服用剂量：20mg/kg，每隔8h服用一次。得到该儿童平均每天服用的剂量为0.06g，qd。故4天需服用的剂量为0.24，8天需服用的剂量为0.48，12天需服用的剂量为0.72，故0.5g，q4d（D对）最为接近计算结果。